心排出量是
A. 心脏每搏动一次所泵出的血量
B. 左、右心室输出的总血液量
C. 每分钟左心室或右心室所泵出的血量
D. 心房进入心室的血量
E. 每分钟两心房进入心室的血量

正确答案：C。每分钟左心室或右心室所泵出的血量